下面关于面神经的说法何者正确
A. 分布到面部皮肤
B. 分支支配咀嚼肌运动
C. 管理下颌下腺分泌
D. 分支管理腮腺的分泌活动
E. 无

正确答案：C。管理下颌下腺分泌

解析：面神经的一般内脏运动纤维分布于下颌下腺等腺体，管理其分泌（C对）。分布到面部皮肤（A错）、分支支配咀嚼肌运动（B错）均为三叉神经的特点。分支管理腮腺的分泌活动（D错）为舌咽神经的特点。